患者，女，5岁。自幼体弱，易患呼吸道感染。查体：心前区稍隆起，无震颤，胸骨左缘2～3肋间闻及3/6级收缩期杂音，P₂亢进，固定分裂。最可能的诊断是
A. 房间隔缺损
B. 室间隔缺损
C. 动脉导管未闭
D. D法洛四联症
E. 风湿性心脏病

正确答案：A。房间隔缺损

解析：患者，女，5岁。自幼体弱，易患呼吸道感染（肺循环血流增多而易反复发生呼吸道感染见于多种先天性心脏病）。查体：心前区稍隆起（心脏增大的体征），无震颤，胸骨左缘2～3肋间闻及3/6级收缩期杂音，P₂亢进，固定分裂（房间隔缺损的听诊特点）。综合患儿症状、体征，此患儿最可能的诊断是房间隔缺损（A对）。室间隔缺损（B错）时缺损小时可无症状，缺损大时表现为消瘦，活动后乏力、气短，听诊有胸骨左缘第3、4肋间可闻及Ⅲ-Ⅳ粗糙全收缩期杂音，向四周广泛传导。动脉导管未闭（C错）易发生于早产儿，听诊有胸骨左缘上方有一连续性“机器”样杂音，占整个收缩期与舒张期，杂音向左锁骨下、颈部和背部传导。法洛四联症（D错）表现为紫绀，少动，蹲踞症状、杵状指、阵发性缺氧表现等，听诊胸骨左缘2～4肋间可闻Ⅲ级收缩期喷射性杂音。风湿性心脏病（E错）是由于风湿热累及心脏，主要有心肌炎，表现为安静时心动过速、心音低顿，可闻及奔马律和主动脉瓣区舒张中期杂音；心内膜炎时表现为心尖部吹风样全收缩期杂音（二尖瓣关闭不全的体征）或胸骨左缘第3肋间舒张期叹气样杂音（主动脉瓣关闭不全的体征）。